患者，男，9岁，入院诊断为急性淋巴细胞白血病，临床计划腔内注射药物预防中枢白血病；宜选用
A. 亚叶酸钙
B. 维生素B₆
C. 甲氨蝶呤
D. 长春新碱
E. 地塞米松

正确答案：C。甲氨蝶呤

解析：本题考查甲氨蝶呤。腔内注射用于癌性胸水、腹水、心包积液、膀胱癌等，临床常用可经脑脊液途径给药的有甲氨蝶呤（C对）和阿糖胞苷。亚叶酸钙（A错）为抗肿瘤治疗用解毒药。用于预防甲氨蝶呤过量或大剂量治疗后所引起的严重毒性作用。维生素B₆（B错）用于维生素B₆缺乏的预防和治疗，防止异烟肼中毒，也可用于妊娠、放射病及抗癌药所致的呕吐，脂溢性皮炎等。长春新碱（D错）用于急性白血病，尤其是儿童急性白血病，对急性淋巴细胞白血病疗效显著，恶性淋巴瘤，生殖细胞肿瘤，小细胞肺癌、尤文肉瘤、肾母细胞瘤、神经母细胞瘤，乳腺癌、慢性淋巴细胞白血病、消化道癌、黑色素瘤及多发性骨髓瘤等。地塞米松（E错）主要适用于过敏性与自身免疫性炎症性疾病，如结缔组织病，严重的支气管哮喘，皮炎等过敏性疾病，溃疡性结肠炎，急性白血病，恶性淋巴瘤，还用于某些肾上腺皮质疾病的诊断、非感染性口腔黏膜溃疡。